最适于治疗肺水肿的药物是
A. 呋塞米
B. 氢氯噻嗪
C. .氨苯蝶啶
D. 螺内酯
E. 乙酰唑胺

正确答案：A。呋塞米